出现粪便黑色，有光泽，且粪便潜血试验呈阳性症状时，首先考虑的疾病是
A. 阿米巴痢疾
B. 过敏性肠炎
C. 痔疮、肛裂
D. 胃、十二直肠溃疡伴出血
E. 抗生素相关性腹泻

正确答案：D。胃、十二直肠溃疡伴出血

解析：本题考查粪常规检查。出现粪便黑色，有光泽，且粪便潜血试验呈阳性症状时，首先考虑的疾病是胃、十二直肠溃疡伴出血（D对）。柏油样黑便、并有光泽，为上消化道出血后，红细胞被消化液消化所致，如粪便持续隐血强阳性，基本可确定为上消化道出血。阿米巴痢疾（A错）主要表现为脓血便（以血为主，呈暗红果酱色）。过敏性肠炎（B错）主要表现为胨状便。痔疮、肛裂（C错）等下消化道出血主要表现为鲜血便。抗生素相关性腹泻（E错）主要表现为稀糊状或水样便。